肺内局限性的湿啰音提示
A. 急性肺水肿
B. 胸腔积液
C. 炎性病变
D. 气管痉挛
E. 肺不张

正确答案：C。炎性病变

解析：湿啰音是由于吸气时气体通过呼吸道内的分泌物如渗出液、痰液、血液、黏液和脓液等，形成的水泡破裂所产生的声音，肺内局限性的湿啰音提示有炎性病变（C对）如肺炎等。急性肺水肿（A错）主要表现为两肺野满布湿啰音。胸腔积液（B错）一般只有累及肺部组织时才会出现湿啰音。气管痉挛（D错）可出现干啰音。肺不张（E错）一般在合并感染后才可能出现湿啰音。